更年期自主神经紊乱的特点不包括
A. 情绪不稳
B. 潮热
C. 腰背痛
D. 心悸
E. 耳鸣

正确答案：C。腰背痛

解析：本题考查更年期自主神经紊乱的特点。腰背痛（C错，为本题正确答案）是大部分出现在妊娠期间的症状。更年期自主神经紊乱的特点：通常表现为心慌、心悸（D对）、胸闷、耳鸣（E对）、潮热（B对）、情绪不稳（A对）等现象。经过检查后未发现器质性原因，可能考虑为更年期综合征。随着内分泌激素水平的变化，而出现一系列自主神经紊乱的症状。